通过抑制黄嘌呤氧化酶而抑制尿酸的生成，在肝脏中可代谢为有活性的别黄嘌呤的药物是
A. 别嘌醇
B. 非布索坦
C. 苯溴马隆
D. 丙磺舒
E. 秋水仙碱

正确答案：A。别嘌醇

解析：本题考查抗痛风药的作用机制。别嘌醇（A对）是通过抑制黄嘌呤氧化酶来抑制尿酸生成的药物，可以降低血中尿酸的浓度，减少尿酸在关节等处的沉积，在肝脏中可代谢为有活性的别黄嘌呤。非布索坦（B错）为目前世界上最新研制的黄嘌呤氧化酶抑制剂，其通过高度选择性地作用于该氧化酶，减少体内尿酸合成，降低尿酸浓度，从而有效治疗痛风。苯溴马隆（C错）的抗痛风机制主要是通过抑制肾小管对尿酸的重吸收，从而降低血中的尿酸浓度。丙磺舒（D错）抑制尿酸盐在近曲小管的主动重吸收，增加尿酸的排泄而降低血中尿酸盐的浓度。秋水仙碱（E错）为一种天然产物，能抑制细胞菌丝分裂，可用于肿瘤的治疗，也可以抑制炎症因子的产生，控制尿酸盐对关节造成的损害。